男，45岁，因肝硬化（失代偿期）入院。1天前出现明显呼吸困难，查体：体温正常，双肺呼吸音清，血气分析示低氧血症。抗感染治疗无效。最可能发生的并发症是
A. 肺炎
B. 肝肾综合征
C. 肝肺综合症
D. 支气管哮喘
E. 急性左心衰

正确答案：C。肝肺综合症

解析：中年男性患者，有肝硬化病史。1天前出现明显呼吸困难，血气分析示低氧血症，考虑诊断为肝肺综合征（C对）。肝肾综合征（B错）临床主要表现为肝硬化伴少尿、无尿及氮质血症。肺炎（P42）（A错）患者有体温升高，抗感染治疗有效；支气管哮喘（P29）（D错）双肺可闻及广泛的哮鸣音；急性左心衰（P174-P175）（E错）患者咳粉红色泡沫状痰。